患者平素眩晕，耳鸣。突然发生口舌㖞斜，舌强语謇，半身不遂，但其神志清楚，舌红，脉弦滑。治疗应首选
A. 大秦艽汤
B. 镇肝息风汤
C. 龙胆泻肝汤
D. 地黄饮子
E. 苏合香丸

正确答案：B。镇肝息风汤

解析：据本病例特点，结合平素眩晕耳鸣病史，故诊断为中风；患者口舌㖞斜，舌强语謇，半身不遂，但其神志清楚，故诊断为中经络；肾阴素亏，肝阳上亢，故平素眩晕耳鸣；风阳内动，挟痰走窜经络，脉络不畅，故突发半身不遂，口舌歪斜，舌强语謇；脉弦主肝风；舌红苔黄，脉数系肝肾阴虚而生内热，故其证型为阴虚风动证。肝肾阴虚，风阳内动，治以滋阴潜阳，熄风通络，代表方为镇肝熄风汤（B对）。大秦艽汤功能疏风清热，养血活血，为治疗络脉空虚，风邪入中的选方，见第五版教材P209-210（A错）。龙胆泻肝汤功能清利肝胆湿热，为治疗胁痛肝胆湿热证选方（C错）。地黄饮子功能滋肾阴，补肾阳，开窍化痰，为治疗中风恢复期肝肾亏虚证的选方（D错）。苏合香丸功能芳香化浊，理气温通开窍，为治疗寒凝心脉证的选方（E错）。